能说明大肠癌筛查长远期效果的证据是
A. 开展筛查地区的发病率低于未筛查人群
B. 开展筛查地区的大肠癌诊断年龄低于未筛查地区
C. 参与筛查的人群大肠癌发病率低于未参与筛查人群
D. 参与筛查的人群大肠癌死亡率低于未参与筛查人群
E. 随着筛查项目时间延长，大肠癌发病率持续上升

正确答案：D。参与筛查的人群大肠癌死亡率低于未参与筛查人群

解析：本题考查筛检生物学效果评价。如果经筛检的病例较未经筛查的复发率或病死率更低，生存率较高或者生存时间更长，则说明筛查可能有效，常用长期效果来评价。本题能说明大肠癌筛查长远期效果的证据是参与筛查的人群大肠癌死亡率低于未参与筛查人群（D对ABCE错）。